观察法收集资料的特点是
A. 收集社会现象的方法
B. 收集非语言资料的方法
C. 间接的资料收集方法
D. 节省时间不用记录
E. 不准确的资料收集方法

正确答案：B。收集非语言资料的方法